下列中药、化学药联合应用，不存在重复用药的是
A. 新癀片+吲哚美辛胶囊
B. 曲克芦丁片+维生素C片
C. 脉君安片+氢氯噻嗪片
D. 消渴丸+格列本脲片
E. 珍菊降压片+氢氯噻嗪片

正确答案：B。曲克芦丁片+维生素C片

解析：本题考查重复用药。曲克芦丁片和维生素C片（B对）联合应用，不属于重复用药。新癀片所含西药成分为吲哚美辛（A错）。脉君安片所含西药成分为氢氯噻嗪（C错）。消渴丸所含西药成分为格列本脲（D错）。珍菊降压片所含西药成分为盐酸可乐定、氢氯噻嗪（E错）。